增加维生素C的摄入量可抑制食管癌发生的机制是
A. 减少亚硝酸盐的摄入
B. 阻断亚硝基化反应
C. 抑制胃内硝酸盐还原菌的活性
D. 增加亚硝酸盐的排出
E. 抑制亚硝酸盐的吸收

正确答案：B。阻断亚硝基化反应

解析：本题考查阻断亚硝基化反应。增加维生素C的摄入量可抑制食管癌发生的机制是阻断亚硝基化反应（B对ACDE错）。